关于肾窦的描述，正确的是
A. 是肾门向肾内延续的腔
B. 由肾皮质围成
C. 内有肾动脉和肾静脉主干
D. 内有输尿管上端
E. 肾窦为肾盂的延续

正确答案：A。是肾门向肾内延续的腔

解析：肾窦是肾门的延续（E错，A对），内含肾血管、肾小盏、肾大盏、肾盂和脂肪等结构，不包括输尿管上端（D错），肾血管在入肾窦前已分支（C错）。